女，47岁。胃癌术后2年，下腹不适3个月。妇科检查：子宫正常大小，双侧附件区各触及一个手拳大小的椭圆形包块，移动性浊音（-）。最可能的诊断是
A. 卵巢卵黄囊瘤
B. 卵巢纤维瘤
C. 卵巢库肯勃瘤
D. 卵巢子宫内膜异位囊肿
E. 卵巢畸胎瘤

正确答案：C。卵巢库肯勃瘤

解析：患者为中年妇女，胃癌术后2年（怀疑胃癌复发并发生转移，形成卵巢库肯勃瘤），下腹不适3个月。妇检：子宫正常大小，双侧附件区各触及一个手拳大小的椭圆形包块（卵巢多为双侧性，中等大小，两侧形态相似，为肾形或结节状，实性）（第2版实用妇产科学P711），移动性浊音（﹣）。最可能的诊断是卵巢库肯勃瘤（C对）。卵巢卵黄囊瘤（P329）（A错）与卵巢畸胎瘤（P329）（E错）同属于卵巢生殖细胞肿瘤，多发生于年轻妇女及幼女，前者多为单侧，恶性程度高，生长迅速，易早期转移，血清AFP升高；后者可分为成熟畸胎瘤和未成熟畸胎瘤，多为单侧。卵巢纤维瘤（P330）（B错）多为单侧，实性，质硬，伴腹腔积液（移动性浊音阳性）或胸腔积液。卵巢子宫内膜异位囊肿（P270）（D错），又称卵巢巧克力囊肿，典型症状为继发性痛经、进行性加重，双合诊检查时，可发现子宫后倾固定，一侧或双侧附件处触及囊实性包块，活动差。